检测Ig和补体的含量可采用
A. 双向琼脂扩散
B. 单向琼脂扩散
C. 直接凝集实验
D. 间接凝集实验
E. 协同凝集实验

正确答案：B。单向琼脂扩散